儿童期出现的甲状腺结节的恶性率为
A. 0.1
B. 0.3
C. 0.5
D. 0.7
E. 0.8

正确答案：C。0.5

解析：儿童时期出现的甲状腺结节有50%（C对）是恶性的（五版外科学P343）。